上肢肌按位置可分为肩肌、臂肌、前臂肌和手肌，数量较多，功能复杂，使上肢的运动复杂多样。下列何者与肩关节的运动无关
A. 肱二头肌
B. 肱三头肌
C. 肱肌
D. 喙肱肌
E. 胸大肌

正确答案：C。肱肌

解析：肱二头肌（A对）屈肘关节，使前臂旋后，并协助屈肩关节。肱三头肌（B对）伸肘关节，并协助肩关节伸及内收。肱肌（C错，为本题正确答案）屈肘关节，与肩关节的运动无关。喙肱肌（D对）使肩关节屈和内收。胸大肌（E对）使肩关节内收、旋内和前屈。